某男，50岁。患慢性肾功能衰竭尿毒症早期，症见少气乏力、腰膝酸软、恶心呕吐、肢体浮肿、面色萎黄，证属脾肾亏损、瘀血阻滞，医师处以尿毒清颗粒，此因该成药除通腑降浊、活血化瘀外，又能
A. 健脾燥湿
B. 凉血解毒
C. 健脾利湿
D. 理气燥湿
E. 凉血利湿

正确答案：C。健脾利湿

解析：本题考查的是尿毒清颗粒的功能。患慢性肾功能衰竭尿毒症早期，症见少气乏力、腰膝酸软、恶心呕吐、肢体浮肿、面色萎黄，证属脾肾亏损、瘀血阻滞，医师处以尿毒清颗粒，此因该成药除通腑降浊、活血化瘀外，又能健脾利湿（C对）。尿毒清颗粒：【功能】通腑降浊，健脾利湿，活血化瘀。白术：【功效】补气健脾，燥湿（A错）利水，止汗，安胎。一清颗粒：【功能】清热泻火解毒（B错），化瘀凉血止血。二陈丸：【功能】燥湿化痰，理气（D错）和胃。北刘寄奴：【功效】活血祛瘀，通经止痛，凉血止血，清热利湿（E错）。